关于药物是否适合制成混悬剂的说法错误的是
A. 为了使毒剧药物的分剂量更加准确，可考虑制成混悬剂
B. 难溶性药物需制成液体制剂时，可考虑制成混悬剂
C. 药物的剂量超过溶解度，而不能以溶液的形式应用时，可考虑制成混悬剂
D. 两种溶液混合，药物的溶解度降低而析出固体药物时，可考虑制成混悬剂
E. 为了使药物产生缓释作用，可考虑制成混悬剂

正确答案：A。为了使毒剧药物的分剂量更加准确，可考虑制成混悬剂

解析：本题考查制成混悬剂的条件。制成混悬剂的条件：①难溶性药物需制成液体制剂供临床应用时；②药物的剂量超过溶解度而不能以溶液剂形式应用时；③两种溶液混合时药物的溶解度降低而析出固体药物时；④为了使药物产生缓释作用。为了安全起见，剧毒药或剂量小的药物不应制成混悬剂使用（A错。为本题正确答案）。